不属于基底核的是
A. 尾状核
B. 屏状核
C. 齿状核
D. 杏仁体
E. 豆状核

正确答案：C。齿状核

解析：不属于基底核的是齿状核（C对），齿状核属于小脑核。尾状核（A错）、屏状核（B错）、杏仁体（D错）、豆状核（E错）均属于基底核的组成部分。